有关肱动脉的描述，正确的是
A. 于胸大肌下缘续腋动脉
B. 在肱二头肌深面下行
C. 在桡骨颈平面分二终支
D. 全长位置均较深
E. 正中神经经过动脉后方至其内侧

正确答案：C。在桡骨颈平面分二终支

解析：肱动脉与正中神经伴行沿肱二头肌的内侧至肘窝，在平桡骨颈的高度分为桡动脉和尺动脉二终支（C对）。